对雌激素生理作用的叙述，正确的是
A. 抑制输卵管平滑肌节律性收缩的振幅
B. 促进水钠潴留，维持和促进骨基质代谢
C. 抑制子宫收缩
D. 使宫颈口闭合，黏液分泌减少、变黏稠
E. 加快阴道上皮细胞脱落

正确答案：B。促进水钠潴留，维持和促进骨基质代谢

解析：雌激素的生理作用主要包括对生殖器作用、对乳腺和副性征作用、对骨骼生长发育的影响、对心血管系统、神经系统的影响。对骨骼影响为促进水钠潴留，维持和促进骨机制代谢（B对）。对生殖器官的作用包括促进子宫发育，子宫内膜增生，使内膜具有对胚胎的接受性；使排卵期宫颈口松弛，子宫颈分泌大量清亮、稀薄的黏液，有利于精子穿过进入宫腔（D错）；促进子宫平滑肌细胞增生肥大，收缩力增强，对缩宫素的敏感性增加（C错）；促进输卵管上皮中纤毛细胞和分泌细胞的增生，促进输卵管的收缩和纤毛摆动，有利于精子在其中的运行（A错）；促进阴道上皮增生和角化（E错），使阴道分泌物呈酸性，增强对感染的抵抗力；与FSH协同促进卵泡发育。